下列疾病中取唇腺活检能够判定疾病的是
A. 慢性化脓性腮腺炎
B. 多形性腺瘤
C. 慢性硬化性唾液腺炎
D. 舍格伦综合征
E. 坏死性唾液腺化生

正确答案：D。舍格伦综合征

解析：舍格伦综合征的唇腺的病理变化与大唾液腺基本相似，因此多取唇腺组织进行病理检测。掌握“坏死性唾液腺化生与舍格伦综合征”知识点。